产生热效应的热辐射主要是
A. 紫外线
B. 红外线
C. 红外线及部分可见光
D. 紫外线及部分可见光
E. 激光

正确答案：C。红外线及部分可见光

解析：本题考查热辐射的概念。任何具有温度的物体都可以电磁波的形式向外散发热量，称为热辐射，其形式主要是红外线及一部分可见光（C对ABDE错）。红外线不直接加热空气，但可使受照物体或人体加热升温。当物体表面温度超过人体表面温度时，物体向人体传递热辐射而使人体受热，称为正辐射。反之则人体向周围物体辐射散热，称为负辐射。